能在无生命培养基上生长繁殖的最小的原核细胞型微生物是
A. 细菌
B. 衣原体
C. 支原体
D. 立克次体
E. 病毒

正确答案：C。支原体